每周漱口使用的是
A. 0.02%NaF漱口液
B. 0.05%NaF漱口液
C. 0.2%NaF漱口液
D. 0.2%氯己定液
E. 0.12%氯己定液

正确答案：C。0.2%NaF漱口液

解析：本题考查氟的全身及局部应用。含氟漱口液的使用方法：0.2%NaF（900mg/L）溶液（C对）：每周使用一次。适用于学校或幼儿园的防龋项目，需要在老师或专业人员的监督下使用。